藏药理论认为，土元和水元生
A. 苦味
B. 甘味
C. 辛味
D. 涩味
E. 咸味

正确答案：B。甘味

解析：本题考查的是藏药的六味。藏药理论认为，土元和水元生甘味（B对）。藏药的六味：甘、酸、咸、苦、辛、涩。药物气味由药物中的五元所决定。土和水元生甘味；火和土元生酸味；火和水元生咸味（E错）；水和风元生苦味（A错）；火和风元生辛味（C错）；土和风元生涩味（D错）。各药味有其自己的功能。